接种白喉抗毒素的同时，注射白喉类毒素，这种疫苗称为
A. 自然自动疫苗
B. 自然被动疫苗
C. 人工自动疫苗
D. 人工被动疫苗
E. 人工自动被动疫苗

正确答案：E。人工自动被动疫苗

解析：本题考查人工被动自动免疫。人工被动自动免疫是指同时给机体接种抗原物质和抗体，使机体迅速获得特异性抗体，并刺激机体产生持久的免疫力。接种白喉抗毒素的同时，注射白喉类毒素，这种疫苗称为人工自动被动疫苗（E对ABCD错）。